SCL-90属于
A. 人格测验问卷
B. 智力测验
C. 人格投射测验
D. 评定量表
E. 神经心理学测验

正确答案：D。评定量表